脑挫裂伤意识障碍取决于
A. 损伤的部位
B. 损伤的程度
C. 损伤的时间
D. 周围的环境
E. 损伤的原因

正确答案：B。损伤的程度

解析：脑挫裂伤是脑组织的实质性损伤，意识障碍取决于脑损伤的程度，神经系统体征取决于损伤部位。掌握“口腔颌面部创伤急救”知识点。